关于检查砷盐的二乙基二硫代氨基甲酸银的法，正确的有
A. 金属锌与碱作用，产生新生态的氢
B. 新生态的氢与药物中微量砷盐反应，生成具有挥发性的砷化氢
C. 砷化氢氧化二乙基二硫代氨基甲酸银，生成胶态银
D. 生成的胶态银溶液呈红色
E. 生成的胶态银溶液可溶于510nm的波长处测定吸光度

正确答案：B、C、D、E。新生态的氢与药物中微量砷盐反应，生成具有挥发性的砷化氢；砷化氢氧化二乙基二硫代氨基甲酸银，生成胶态银；生成的胶态银溶液呈红色；生成的胶态银溶液可溶于510nm的波长处测定吸光度

解析：本题考查砷盐检查法。砷盐的二乙基二硫代氨基甲酸银检查原理：金属锌与酸作用产生新生态氢，与微量砷盐反应生成具有挥发性的砷化氢（B对），还原氢氧化二乙基二硫代氨基甲酸银，生成红色（D对）胶态银（C对）。同时在相同的条件下使一定量标准砷溶液呈色，用比目法或510nm波长处测定吸收光（E对）进行比较。